呈放射状，保护根尖孔的血管和神经的是
A. 牙槽嵴组
B. 水平组
C. 斜行组
D. 根间组
E. 根尖组

正确答案：E。根尖组

解析：根尖组：起于根尖区牙骨质，呈放射状止于根尖周围的牙槽骨，具有固定牙根尖的作用。掌握“牙周膜”知识点。